初产妇，26岁。妊娠39周，临产后9小时，胎儿娩出5分钟，胎盘未娩出。不恰当的处理是
A. 用力压耻骨联合上方
B. 检查宫体是否变硬
C. 观察脐带有无自行延长
D. 阴道有无流血
E. 轻压耻骨联合上方

正确答案：A。用力压耻骨联合上方

解析：胎盘未娩出，接产者不应在胎盘尚未完全剥离时用力压耻骨联合上方（A错，为本题正确答案），以免引起胎盘部分剥离而出血或拉断脐带，甚至造成子宫内翻。检查宫体是否变硬（B对）、观察脐带有无自行延长（C对）、阴道有无流血（D对）、轻压耻骨联合上方（E对）观察宫体上升而外露的脐带不再回缩均是判断胎盘剥离征象的指标。